患者，男，72岁，体重75kg，1小时前出现右上肢体活动不利，半小时后自行缓解。查体：血压210/90mmHg；实验室检查结果：糖化血红蛋白9.3%，血肌酐143.2㎛ol/L。磁共振显像血管造影（MRA）：左侧大脑中动脉90%狭窄。既往有高血压、糖尿病、冠心病病史。诊断为短暂性脑缺血发作。首选的抗血栓药物是
A. 阿司匹林联合氯吡格雷
B. 阿司匹林
C. 阿替普酶
D. 氯吡格雷
E. 依诺肝素

正确答案：A。阿司匹林联合氯吡格雷

解析：本题考查短暂性脑缺血发作治疗。短暂性脑缺血发作首选的抗血栓药物是阿司匹林联合氯吡格雷（A对）。阿司匹林（B错）是抗血小板药的代表药，对所有发生急性缺血性心血管事件的患者，如心肌梗死、不稳定型心绞痛、缺血性脑卒中、一过性脑缺血发作等，若无禁忌，应尽快给予阿司匹林，每日150～300mg，1～7日之后改为每日75～150mg，长期服用，对所有诊断为冠心病或缺血性脑卒中的患者均应长期服用阿司匹林，每日75～150mg，作为二级预防。氯吡格雷（D错）用于近期心肌梗死（从几天到小于35天）、近期缺血性卒中（从7天到小于6个月）或确诊外周动脉性疾病及急性冠脉综合征，非ST段抬高性急性冠脉综合征（包括不稳定性心绞痛或非Q波心肌梗死），包括经皮冠状动脉介入术后置入支架，ST段抬高性急性冠脉综合征的患者预防动脉粥样硬化血栓形成事件。阿替普酶（C错）用于急性心肌梗死、肺栓塞、缺血性脑卒中。依诺肝素（E错）预防深静脉血栓形成及肺栓塞，治疗已形成的静脉血栓，预防血液透析时体外循环中血栓的形成，治疗不稳定性心绞痛和非Q波心梗。